固定义齿修复后引起龈炎的原因为
A. 菌斑附着
B. 龈组织受压
C. 接触点不正确
D. 粘接剂未去净
E. 以上说法均正确

正确答案：E。以上说法均正确

解析：龈炎：固定桥粘固后引起的牙龈充血、水肿，患者刷牙、咀嚼食物时出现少量出血。（1）粘接剂未去净：固定桥粘固后，位于牙间隙内的多余粘固剂没去净，刺激龈组织引起炎症。（2）菌斑附着：固位体边缘不密合，或全冠固位体、桥体颊舌侧轴面外形恢复不正确，自洁作用遭破坏，引起龈缘菌斑附着，造成局部炎症。（3）龈组织受压：固位体边缘或桥体龈端过长，直接压迫和刺激牙龈，形成创伤性炎症。（4）接触点不正确：固位体与邻牙接触点位置恢复不正确或接触点松，引起食物嵌塞而导致龈炎。掌握“固定桥修复后出现的问题及处理”知识点。